肠管迅速膨胀，肠管变薄，可引起等渗性缺水的原因是
A. 动力性肠梗阻
B. 绞窄性肠梗阻
C. 低位肠梗阻
D. 急性完全性肠梗阻
E. 慢性肠梗阻

正确答案：D。急性完全性肠梗阻

解析：引起低渗性缺水（P11）的肠梗阻多为慢性肠梗阻，引起等渗性缺水的肠梗阻多为急性肠梗阻（D对）（P359）。